水痘的临床特征是
A. 好发于年长儿
B. 好发于夏、秋季
C. 丘疹、疱疹、结痂并存
D. 疱疹壁较薄，易破溃
E. 皮疹多分布在头、手部，躯干部少

正确答案：C。丘疹、疱疹、结痂并存

解析：水痘是一种传染性强的疾病，其皮疹分批出现，在同一时期，丘疹、疱疹、干痂并见（C对）。好发于10岁以下小儿，以6-9岁儿童多见（A错）。多发于冬春二季（B错）。典型疱疹呈卵圆形，壁薄易破，但非其临床特征（D错）。周身可见疱疹，以躯干部为主（E错）。